手臂振动病是
A. 以末梢循环障碍为主的疾病
B. 以末梢神经退行性变为主的疾病
C. 以手指骨骼变性为主的疾病
D. 以手部皮肤缺血为主的疾病
E. 以手部肌肉和血管损伤为主的疾病

正确答案：A。以末梢循环障碍为主的疾病